关于脑脊液的描述，正确的是
A. 主要产生于脑室的室管膜上皮
B. 位于硬脊膜与蛛网膜之间
C. 充满蛛网膜下隙
D. 经室间孔流入蛛网膜下隙
E. 经脉络丛渗入上矢状窦

正确答案：C。充满蛛网膜下隙

解析：脑脊液主要产生于脑室脉络丛，少量产生于室管膜上皮（A错）和毛细血管。侧脑室脉络丛产生的脑脊液经室间孔流至第三脑室，与第三脑室脉络丛产生的脑脊液一起，经中脑水管流入第四脑室，再汇合第四脑室脉络丛产生的脑脊液一起经第四脑室正中孔和两个外侧孔（D错）流入脑和脊髓周围的蛛网膜下隙（C对B错），然后脑脊液再沿此隙流向大脑背面的蛛网膜下隙，经蛛网膜粒（E错）渗透到硬脑膜窦内（主要是上矢状窦），回流入血液中。